狂犬病病毒感染侵害的细胞是
A. 神经细胞
B. 皮肤粘膜
C. CD4+细胞
D. 成纤维细胞
E. 呼吸道粘膜细胞

正确答案：A。神经细胞

解析：狂犬病病毒是弹状病毒科狂犬病毒属中能引起急性脑组织病变的嗜神经病毒。掌握“狂犬病、人乳头瘤病毒”知识点。